哪一项不是急性牙髓炎疼痛的特点
A. 夜间痛比白天重
B. 不能定位
C. 温度刺激疼痛加重
D. 自发性痛、阵发性加剧
E. 坐位比卧位重

正确答案：E。坐位比卧位重

解析：本题考查急性牙髓炎疼痛的特点。急性牙髓炎疼痛与体位变化无关，坐位与卧位疼痛程度无明显区别（E错，为本题的正确答案），髓腔内牙髓钙化成游离髓石的患牙可出现与体位有关的自发痛。急性牙髓炎的临床特点是发病急，疼痛剧烈，其疼痛的特点有：夜间痛比白天重（A对），患者常因牙痛难以入眠，或从睡眠中痛醒，可能与迷走神经在夜间活跃有关；疼痛不能自行定位（B对），疼痛发作时患者大多不能明确指出患牙所在；温度刺激疼痛加重（C对），冷、热刺激可激发患牙的剧烈疼痛；自发性痛、阵发性加剧（D对），在未受到任何外界刺激的情况下，突然发生剧烈的自发性尖锐疼痛，疼痛可分为持续性过程和缓解过程，即所谓的阵发性痛。